胆固醇体内合成的原料
A. 胆汁酸盐和磷脂酰胆碱
B. 17-羟类固醇和17-酮类固醇
C. 胆汁酸和VD等
D. 乙酰CoA和NADPH
E. 胆汁酸

正确答案：D。乙酰CoA和NADPH

解析：合成胆固醇的基本原料是乙酰CoA，并需ATP供能，NADPH+H+供氢。合成1分子胆固醇需18分子乙酰CoA，16分子NADPH+H+及36分子ATP。掌握“甘油磷脂、胆固醇和血脂蛋白代谢”知识点。